甘松的功效是
A. 开郁醒脾
B. 燥湿化痰
C. 破气消积
D. 降气止呃
E. 调经止痛

正确答案：A。开郁醒脾

解析：本题考查甘松的功效。甘松的功效是开郁醒脾（A对）。甘松【功效】行气止痛，开郁醒脾。化橘红【功效】理气宽中，燥湿化痰（B错），消食。枳实【功效】破气消积（C错），化痰除痞。柿蒂【功效】降气止呃（D错）。香附【功效】疏肝理气，调经止痛（E错）。